女孩，5岁。头痛，呕吐，步行不稳3个月。查体：神志清楚，精神差，双侧视乳头水肿。最可能的诊断是
A. 小脑髓母细胞瘤
B. 颞叶胶质细胞瘤
C. 矢状窦旁脑膜瘤
D. 枕叶星形细胞瘤
E. 顶叶恶性淋巴瘤

正确答案：A。小脑髓母细胞瘤

解析：患儿5岁，步行不稳（共济失调的表现），头痛、呕吐、双侧视乳头水肿（颅内压升高的症状），定位诊断考虑小脑病变可能性大，定性诊断考虑肿瘤可能性大，最可能的诊断为小脑髓母细胞瘤（A对）。胶质细胞瘤又称神经胶质瘤，广义是指所有神经上皮来源的肿瘤，狭义是指源于各类胶质细胞的肿瘤，累及颞叶的肿瘤常有有精神障碍（情感障碍为主）、复杂部分性癫痫发作（精神运动型癫痫）、视野缺损和感觉性失语（B错）。矢状窦旁脑膜瘤（C错）以头痛为主要症状，有慢性进行性加重的人格改变、痴呆、木僵和感情淡漠等，可有癫痫大发作及继发性视乳头水肿或锥体束征。星形细胞瘤是指以星形胶质细胞所形成的肿瘤，肿瘤的不断生长占据颅腔内空间，肿瘤阻塞脑脊液循环通路造成脑积水和（或）脑水肿，脑脊液的回吸收障碍等均可造成颅内压增高，如头痛、呕吐等，累及枕叶的星形细胞瘤多伴视野缺损（D错）。恶性淋巴瘤是一组起源于淋巴造血系统的恶性肿瘤的总称，其主要临床表现是无痛性淋巴结肿大，可出现发热、盗汗、消瘦、皮肤瘙痒等全身症状，累及顶叶的肿瘤有中枢感觉障碍，如形体觉、两点辨别觉受损和命名性失语（E错）。